下列关于氟排泄错误的是
A. 摄入氟最初5个小时排泄最快
B. 成人摄氟量的40%～60%由尿排出
C. 24小时可排出摄入氟的50%以上
D. 3～4小时可排出摄入氟的20%～30%
E. 氟的快速排出对人体是一种保护作用

正确答案：A。摄入氟最初5个小时排泄最快

解析：一般成人摄氟量的40%～60%由尿排出。肾的氟清除率与尿pH和流速呈正比关系。pH高（碱性尿），尿流速快，肾清除氟的速度则快，pH低（酸性尿），尿流速慢，则清除较慢。一般尿氟的排泄速度，在摄入氟的最初4小时最快，3～4小时可排出摄入氟的20%～30%，24小时可排出摄入氟的50%以上。氟的快速排出对人体是一种保护作用。掌握“人体氟摄入及代谢、氟防龋”知识点。